与漏肩风相关的经脉是
A. 手三阴足少阳
B. 手三阴足阳明
C. 手三阳足太阳
D. 手三阴手太阳
E. 手三阳手太阴

正确答案：E。手三阳手太阴

解析：肩前区疼痛为主，后伸疼痛加剧，为手阳明经证；以肩外侧疼痛为主，外展疼痛加剧，为手少阳经证；以肩后侧疼痛为主，肩内收时疼痛加剧，为手太阳经证；以肩前近腋部疼痛为主且压痛明显，为手太阴经证（E对）。足少阳胆经腧穴主治侧头、目、耳、咽喉病，神志病，热病及经脉循行部位的其他病证（A错）。足阳明胃经主治胃肠病、头面五官病、神志病、热病、经脉循行部位的其他病证下肢痿痹，转筋，腰膝冷痛、半身不遂（B错）。足太阳膀胱经穴主治脏腑病证、神志病、头面五官病、经脉循行部位的其他病证，项、背、腰、下肢病证等（C错）。手太阳小肠经主治头面五官病、热病、神志病、经脉循行部位的其他病证，项背强痛，腰背痛，手指及肘臂挛痛等（D错）。